患者，男，45岁。大便秘结不通，排便艰难，伴腹胀痛，身热，口干口臭，喜冷饮，舌红，苔黄，脉滑数。治疗除取主穴外，还应选用的穴位是
A. 足三里、三阴交
B. 中脘、太冲
C. 神阙、关元
D. 合谷、内庭
E. 气海、脾俞

正确答案：D。合谷、内庭

解析：题中患者以大便秘结不通，排便艰难为主症，故诊断为便秘。腹胀痛，身热，口干口臭，喜冷饮，舌红，苔黄，脉滑数均为热邪壅盛之象，故辨为热秘。足三里、三阴交为血虚的配穴（A错）。中脘、太冲为气秘的配穴（B错）。神阙、关元为阳虚的配穴（C错）。合谷、内庭为热秘的配穴（D对）。气海、脾俞为气虚的配穴（E错）。